下列哪项不是病例对照研究样本含量大小的取决因素
A. 欲研究因素在对照人群中估计暴露率P0
B. 欲研究因素所致的发病率P1
C. 估计的该因素引起的相对危险度或暴露的比值比
D. 所希望达到的检验显著性水平α
E. 所希望达到的检验把握度（1﹣β）

正确答案：B。欲研究因素所致的发病率P1

解析：本题考查影响病例对照研究样本量的因素。病例对照研究的样本含量与下列四个条件有关：①研究因素在对照组或人群中的暴露率（P₀）（A对）；②研究因素与疾病关联强度的估计值，即比值比（C对）（OR）；③希望达到的统计学检验假设的显著性水平，即第I类错误（假阳性）概率（α）（D对）；④希望达到的统计学检验假设的效能或称把握度（1－β）（E对）。欲研究因素所致的发病率P₁（B错，为本题正确答案）是队列研究中影响样本量的重要因素。